哪些污染物可引起慢性阻塞性肺病
A. SO₂、NOx
B. 军团杆菌
C. 硫化氢、甲烷
D. CO、CO₂
E. 氡及其子体

正确答案：B。军团杆菌

解析：本题考查可引起慢性阻塞性肺病的污染物。慢性阻塞性肺疾病是一种具有气流阻塞特征的慢性支气管炎和（或）肺气肿，可进一步发展为肺心病和呼吸衰竭的常见慢性疾病。军团杆菌（B对ACDE错）可能是慢性阻塞性肺病的一个重要危险因素，它可以通过呼吸道进入人体，并在支气管中繁殖，最终导致慢性阻塞性肺病的发生。